珠海会议制定的种植义齿成功标准中，要求种植牙的成功率应达到
A. 5年成功率应达到80%以上；10年70%以上
B. 5年成功率应达到80%以上；10年75%以上
C. 5年成功率应达到85%以上；10年75%以上
D. 5年成功率应达到85%以上；10年80%以上
E. 5年成功率应达到90%以上；10年80%以上

正确答案：D。5年成功率应达到85%以上；10年80%以上

解析：1995年中华口腔医学会杂志社在珠海制定的种植成功标准为：①功能好；②无麻木，疼痛等不适；③自我感觉良好；④种植体周围X线无透射区；横行骨吸收不超过1/3，种植体不松动；⑤龈炎可控制；⑥无与种植体相关的感染；⑦对邻牙支持组织无损害；⑧美观；⑨咀嚼效率大于70%；⑩符合上述要求者5年成功率应达到85%以上；10年80%以上。掌握“牙种植手术及效果评估”知识点。